下颌第三磨牙拔除术中的注意事项，除外
A. 远中切口应略偏舌侧，不易引起出血和水肿
B. 颊侧切口与远中切口的末端成45°角向下，勿超过前庭沟，否则将引起颊部肿胀
C. 用锤凿法劈开时，牙冠应已有足够的显露，且牙不松
D. 涡轮钻拔牙法具有无振动，创伤小，术后并发症减少等明显优点
E. 应作黏骨膜全层切开，紧贴骨面将瓣翻起

正确答案：A。远中切口应略偏舌侧，不易引起出血和水肿

解析：拔牙术基本操作术中注意事项：①远中切口如偏舌侧，易引起出血和水肿。②颊侧切口与远中切口的末端成45°角向下，勿超过前庭沟，否则将引起颊部肿胀。③应作黏骨膜全层切开，紧贴骨面将瓣翻起。④用锤凿法去骨时，为避免暴露第二磨牙牙根，应首先在第二磨牙颊远中角之后，与牙槽嵴垂直，凿透密质骨使成一沟。⑤用锤凿法劈开时，牙冠应已有足够的显露，且牙不松，在颊面近中发育沟处，用锐利而合适的器械劈开。⑥涡轮钻拔牙法是近年来较常使用的方法，具有无振动，创伤小，手术视野清楚，手术时间短，术后并发症减少等明显优点。掌握“牙拔除术”知识点。